与亚硝酰铁氰化钠反应
A. 甲型强心苷
B. 乙型强心苷
C. 丙型强心苷
D. 丁型强心苷
E. 戊型强心苷

正确答案：A。甲型强心苷

解析：本题考查的是强心苷的颜色反应。与亚硝酰铁氰化钠反应甲型强心苷（A对）。C-17位上不饱和内酯环的颜色反应：甲型强心苷在碱性醇溶液中，由于五元不饱和内酯环上的双键移位产生C-22活性亚甲基，能与活性亚甲基试剂作用而显色。乙型强心苷（B错）在碱性醇溶液中，不能产生活性亚甲基，无此类反应。所以利用此类反应，可区别甲、乙型强心苷。所产生的有色化合物在可见光区常有最大吸收，故亦可用于定量。鉴别反应如下：①Legal反应：又称亚硝酰铁氰化钠试剂反应；②Raymond反应：又称间二硝基苯试剂反应；③Kedde反应：又称3，5-二硝基苯甲酸试剂反应；④Baljet反应：又称碱性苦味酸试剂反应。没有丙型强心苷（C错）、丁型强心苷（D错）、丙型强心苷（E错）。